保健品是
A. 处方药
B. 非处方药
C. 两者都是
D. 两者都不是

正确答案：D。两者都不是

解析：本题考查保健品。保健品既不是处方药，也不是非处方药（D对）。保健食品，是指声称具有特定保健功能或者以补充维生素、矿物质为目的的食品。即适宜于特定人群食用，具有调节机体功能，不以治疗疾病为目的，并且对人体不产生任何急性、亚急性或者慢性危害的食品。处方药（A错）是指凭执业医师和执业助理医师处方方可购买、调配和使用的药品。非处方药（B错）是指由国家药品监督管理局公布的，不需要凭执业医师和执业助理医师处方，消费者可以自行判断、购买和使用的药品。